经产前检查，医师发现或者怀疑胎儿异常的，应当对孕妇进行
A. 产前诊断
B. 母婴保健
C. 孕妇保健
D. 胎儿保健
E. 产妇保健

正确答案：A。产前诊断

解析：《母婴保健法》规定，经产前检查，孕妇有下列情形之一的，经治医师应当建议其进行产前诊断（A对）：羊水过多或者过少的；胎儿发育异常或者胎儿有可疑畸形的；孕早期时接触过可能导致胎儿先天缺陷的物质的；有遗传病家族史或者曾经分娩过先天性严重缺陷婴儿的；年龄超过35周岁的。